男，腹部外伤后流血不止，送往医院查体血压70/50mmHg，昏迷，四肢凉。该患者此时为
A. 失代偿期轻度休克
B. 失代偿期中度休克
C. 代偿期轻度休克
D. 失代偿期重度休克
E. 代偿期中度休克

正确答案：D。失代偿期重度休克

解析：患者收缩压低于90mmHg说明已经休克失代偿，昏迷表示休克已至重度，故答案选择失代偿期重度休克（D对）。